判断强碱能对弱酸进行准确滴定的条件是
A. C≥10⁻⁶（mol/L）
B. C/Ka≥500
C. C*Ka≥20Kw
D. C*Ka≥10⁻⁸E
E. Ka₁/Ka₂≥10⁴

正确答案：D。C*Ka≥10⁻⁸E